关于胸主动脉的描述，正确的是
A. 在第5胸椎下缘左侧续主动脉弓
B. 行于食管左侧
C. 分出11对肋间后动脉和1对肋下动脉
D. 脏支较壁支大,分布于食管、支气管和心包
E. 下数对肋间后动脉分布于相应的胸壁和腹壁上部

正确答案：E。下数对肋间后动脉分布于相应的胸壁和腹壁上部

解析：脏支较细小（D错），包括支气管动脉，食管动脉和心包支。下数对肋间后动脉分布于相应的胸壁和腹壁上部（E对）。